由中脑背侧出脑的脑神经是
A. 舌神经
B. 面神经
C. 前庭蜗神经
D. 动眼神经
E. 滑车神经

正确答案：E。滑车神经

解析：由中脑背侧出脑的脑神经是滑车神经（E对）；舌神经（A错）于下颌支内侧成弓状下降至口腔底，分布于口腔底和舌前 2/3 的黏膜；面神经（B错）较大的神经根自脑桥小脑角区，脑桥延髓沟外侧部出脑，中间神经自运动根的外侧出脑；前庭蜗神经（C错）包括前庭神经和蜗神经，前庭神经在脑桥小脑三角处，经延髓脑桥沟外侧部入脑，蜗神经经内耳门入颅；动眼神经（D错）由中脑脚间窝出脑。